阳虚证的症状可见
A. 形体消瘦
B. 五心烦热
C. 口燥咽干
D. 形寒肢冷
E. 眩晕失眠

正确答案：D。形寒肢冷

解析：本题考查的是阳虚证的证候。阳虚证的症状可见形寒肢冷（D对）。阴虚与阳虚：阴虚与阳虚，是指机体阴阳亏损而导致的阴不制阳、阳不制阴的阴虚证和阳虚证候。阴虚证的临床表现，除见形体消瘦（A错）、口燥咽干（C错）、眩晕失眠（E错）、舌红脉细数等阴液不足的症状外，还常伴见五心烦热（B错）、潮热盗汗、舌红绛、脉数等阴不制阳、虚热内生的症状。阳虚证的临床表现，除见神疲乏力、少气懒言、蜷卧嗜睡、脉微无力等气虚功能衰减的症状外，还常兼见畏寒肢冷、口淡不渴、尿清便溏或尿少肿胀、面白舌淡等阳不制阴、水寒内盛的症状。